传染性非典型肺炎的病原体为
A. 流感病毒H1N1亚型
B. SARS冠状病毒
C. 流感病毒
D. 麻疹病毒
E. EB病毒

正确答案：B。SARS冠状病毒

解析：SARS冠状病毒为传染性非典型肺炎的病原体（B对）。流感病毒H1N1亚型为甲型H1N1流感的病原体（A错）。流感病毒为流行性感冒的病原体（C错）。麻疹病毒为麻疹的病原体（D错）。EB病毒为传染性单核细胞增多症的病原体（E错）。